患者，男，80岁，患有高血压、2型糖尿病、前列腺增生症。近日出现暂时性尿失禁症状，怀疑与其服用的药物有关。复核其使用的药物，可能造成其尿失禁的药物是
A. 二甲双胍
B. 非那雄胺
C. 依那普利
D. 珍菊降压片（含氢氯噻嗪）
E. 消渴丸（含格列本脲）

正确答案：D。珍菊降压片（含氢氯噻嗪）

解析：本题考查引起尿失禁的药物。可能造成其尿失禁的药物是珍菊降压片（含氢氯噻嗪）（D对）。氢氯噻嗪具有利尿作用，重复用药容易导致患者过度排尿，造成尿失禁。二甲双胍（A错）为双胍类口服降糖药，格列本脲（E错）为磺酰脲类促胰岛素分泌药，二者会使血糖下降。非那雄胺（B错）为抗前列腺增生药。依那普利（C错）为血管紧张素转化酶抑制剂，用于降低血压。